心理社会因素在发病、发展过程中起重要作用的躯体器质性疾病称为
A. 心理疾病
B. 神经症
C. 转换性障碍
D. 心身疾病
E. 躯体疾病

正确答案：D。心身疾病

解析：心理社会因素在发生、发展与转归上起着重要作用，有明确的病理基础、器官出现了形态学改变或组织改变的躯体疾病称为心身疾病（D对）。